属于肝素药理作用
A. 扩张血管
B. 抗凝
C. 抑制中枢神经系统
D. 提高血浆渗透压产生组织脱水作用
E. 升压

正确答案：B。抗凝

解析：本题考查肝素的药理作用。肝素的药理作用是抗凝（B对）。肝素依赖于激活抗凝血酶Ⅲ，可用于治疗各种原因引起的凝血，血栓的形成，还可用于血液标本的抗凝处理。